治疗变异型心绞痛，疗效好的药物是
A. 普萘洛尔
B. 硝苯地平
C. 硝酸甘油
D. 考来烯胺
E. 曲美他嗪

正确答案：B。硝苯地平

解析：本题考查硝苯地平。治疗变异型心绞痛，疗效好的药物是硝苯地平（B对）。硝苯地平是第一代二氢吡啶类的短效钙通道阻滞药，对冠脉的痉挛作用显著，故对变异型心绞痛最有效，伴高血压或窦性心动过缓的患者尤为适用；亦可用于慢性稳定型心绞痛和不稳定型心绞痛的防治。普萘洛尔（A错）可治疗稳定型及不稳定型心绞痛，可减少发作次数，对兼患高血压或心律失常者更为适用。硝酸甘油（C错）通过降低心肌耗氧量、舒张冠状动脉、增加缺血区血液灌注可用于治疗各种类型心绞痛（包括劳累型心绞痛、变异型心绞痛以及不稳定型心绞痛）。考来烯胺（D错）为调血脂药。曲美他嗪（E错）主要用于心绞痛发作的预防性治疗,也可以用于眩晕和耳鸣的辅助性对症治疗。